下列哪种不是疫苗
A. 亚单位疫苗
B. 基因工程疫苗
C. 合成肽
D. 人免疫球蛋白制剂
E. DNA疫苗

正确答案：D。人免疫球蛋白制剂

解析：近年来新发展的疫苗主要有以下几类：亚单位疫苗；结合疫苗；合成肽疫苗；基因工程疫苗（包括重组抗原疫苗、重组载体疫苗、DNA疫苗、转基因植物疫苗）等。掌握“免疫预防及免疫治疗”知识点。